含有吡唑并咪唑杂环，口服后有首过代谢，生物利用度只有30%的药物
A. 奥沙西泮
B. 三唑仑
C. 唑吡坦
D. 艾司佐匹克隆
E. 扎来普隆

正确答案：E。扎来普隆

解析：本题考查镇静催眠药的结构和药动学特点。扎来普隆（E对）属于咪唑并吡啶的衍生物，口服后吸收迅速且完全，有明显的首关效应，生物利用度约为30%。奥沙西泮（A错）口服吸收较好；血药浓度达峰时间（Tmax）为3小时，血浆蛋白结合率为80%～99%，t1/2 5～10小时。三唑仑（B错）口服吸收快而完全，口服15～30分钟起效， Tmax2小时，血浆蛋白结合率约90%，t1/2 1.5～5.5小时。唑吡坦（C错）属于咪唑吡啶类催眠药，口服吸收迅速，口服生物利用度为70%。艾司佐匹克隆（D错）口服吸收迅速；Tmax0.5～2小时；生物利用度为75%～80%。